一位符合安乐死条件的病人，医生使用药物结束其痛苦的生命，称为
A. 强迫安乐死
B. 医助安乐死
C. 被动安乐死
D. 主动安乐死
E. 自杀安乐死

正确答案：D。主动安乐死

解析：根据安乐死的实施方式，可分为主动安乐死和被动安乐死（ABE错）。主动安乐死（D对）是指在无法挽救病人生命的情况下，医务人员等采取药物等方式主动结束病人的生命或加速病人死亡的过程，又称仁慈助死。被动安乐死（C错）是指对需要依赖生命维持技术生存的病人不给予或撤除生命支持，任其死亡，又称为听任死亡。